既可用于干法又可用于湿法粉碎的粉碎机械是
A. 万能磨粉机
B. 万能粉碎机
C. 锤击式粉碎机
D. 气流粉碎机
E. 球磨机

正确答案：E。球磨机

解析：本题考查粉碎方法。既可用于干法又可用于湿法粉碎的粉碎机械是球磨机（E对）。球磨机除广泛应用于干法粉碎外，亦可用于湿法粉碎。如用球磨机水飞制备的炉甘石、朱砂等粉末可达到七号筛的细度，比干法制备的粉末润滑，且可节省人力。万能磨粉机（A错）适用范围广泛，用于根、茎、皮类等中药，干燥的非组织性药物，结晶性药物及干浸膏等的粉碎。但由于构造上的特点，在粉碎中容易产生热量，故不宜用于粉碎含大量挥发性成分、黏性强或软化点低且遇热发黏的药物。柴田式粉碎机：亦称万能粉碎机（B错）。柴田式粉碎机构造简单，使用方便，粉碎能力强，广泛适用于黏软性、纤维性及坚硬的中药的粉碎，但对油性过多的药料不适用。锤式粉碎机（C错）：是很多行业前期生产的一种必需设备，尤其是制药、饲料、食品、涂料、化工行业。它具有广泛的通用性，能调节粉碎细度，具有生产效率高、能耗小、使用安全、维修方便等优点，所以得到了各行各业的青睐。气流粉碎机（D错）：主要适用于的粉碎机理决定了其适用范围广、成品细度高等特点。